中药的纯度检查包括
A. 杂质检查
B. 总灰分测定
C. 酸不溶性灰分测定
D. 浸出物测定
E. 膨胀度测定

正确答案：A、B、C。杂质检查；总灰分测定；酸不溶性灰分测定

解析：本题考查的是中药材的纯度检查方法。中药的纯度检查包括杂质检查（A对）、总灰分测定（B对）与酸不溶性灰分测定（C对）。中药的纯度检查：中药的纯度与中药质量密切相关，常影响中药质量的优劣程度和临床用药剂量的准确性。《中国药典》中与纯度相关的检查主要包括杂质检查、水分测定、干燥失重、灰分测定、色度检查、酸败度测定等，并已成为中药质量评价中的常规检查项。浸出物测定（D错）属于中药的有效性评价。中药的有效性评价包括全草类中药含叶量的检查、浸出物测定与含量测定等。膨胀度测定（E错）属于中药鉴定中的一般理化鉴别。膨胀度测定：膨胀度是药品膨胀性质的指标，是指每1g药品在水或其他规定的溶剂中，在一定的时间与温度条件下膨胀后所占有的体积（ml）。主要用于含黏液质、胶质和半纤维素类的天然药品。